男，70岁。多种慢性病迁延难愈，现虚烦不寐，形体消瘦，易疲劳，头晕健忘，纳少，面色㿠白，舌淡，脉细弱。其治疗宜用
A. 酸枣仁汤
B. 天王补心丹
C. 归脾汤
D. 安神定志丸
E. 朱砂安神丸

正确答案：C。归脾汤

解析：题中患者多种慢性病迁延难愈，形体消瘦，易疲劳，故诊断为虚劳。虚烦不寐，头晕健忘，是心血亏虚，心失所养所致；血虚不能上荣头面，则面色㿠白；纳少为脾虚失运所致。此为心脾血虚证，治疗应用具有补益心脾，益气摄血功能的归脾汤（C对）。酸枣仁汤养血安神，清热除烦，主治肝血不足，阴虚内热引起的诸证（A错）。天王补心丹滋阴养血，补心安神，用于阴虚血少，心悸不安，虚烦神疲，手足心热之症（B错）。安神定志丸镇惊定志，养心安神，为心虚胆怯证之心悸的代表方（D错）。朱砂安神丸清心降火，重镇安神，用于阴血不足，虚火亢盛，惊悸怔忡，心神烦乱，失眠多梦等症（E错）。